县级以上人民政府教育主管部门应当指导、督促有关学校将艾滋病防治知识纳人有关课程，开展有关课外教育活动，但不包括以下哪类学校
A. 高等院校
B. 中等职业学校
C. 普通中学
D. 小学
E. 高等医药院校

正确答案：D。小学